用于诊断与过敏试验的注射途径是
A. 皮内注射
B. 皮下注射
C. 动脉注射
D. 静脉注射
E. 关节腔注射

正确答案：A。皮内注射

解析：本题考查皮内注射。用于诊断与过敏试验的注射途径是皮内注射（A对）；皮下注射（B错）的吸收慢，皮下组织血管较少及血流速度慢，一些需延长作用时间的药物可采用皮下注射；动脉内注射（C错）将药物或诊断药直接输入靶组织或器官；静脉注射（D错）中药物直接进入血液，起效迅速；关节腔注射（E错）是关节腔穿刺技术的一种延伸。